以下对混杂因子的认识，正确的是
A. 混杂因子不是疾病的危险因子
B. 混杂因子与暴露因素无关
C. 混杂因子是与疾病和暴露因素均有关的因子
D. 混杂因子是与暴露因素有关、与疾病无关的因子
E. 混杂因子是与疾病有关与暴露因素无关的因子

正确答案：C。混杂因子是与疾病和暴露因素均有关的因子